某研究用甲、乙两种方法同时测量某市9处水源中氟含量（mg/L），采用Wilcoxon符号秩和检验比较两种方法的测量结果是否不同。计算得T.＝24.5，T_＝20.5，查配对比较的符号秩和检验用T界值表（无差值为0）：当双侧x＝0.10时，T界值范围为8～37；当双侧a＝0.05时，T界值范围为5～40；当双侧a＝0.01时，T界值范围为1～44。则P为
A. P＞0.10
B. 0.05＜P＜0.10
C. P＝0.05
D. 0.01＜P＜0.05
E. P＜0.01

正确答案：A。P＞0.10